女，30岁，开口受限1年，既往有关节弹响史。临床检查见开口度1指半，开口型左偏。首先应进行下列哪项检查
A. 许勒位及下颌开口后前位
B. 许勒位及经咽侧位
C. 许勒位及升支侧位
D. 曲面体层及下颌开口后前位
E. 曲面体层及经咽侧位

正确答案：B。许勒位及经咽侧位

解析：本题考查颞下颌关节紊乱病的辅助诊断方法。许勒位显示颞下颌关节外侧1/3侧斜位影像，颞骨岩部投影于髁突下方，可以同时显示关节窝、关节结节、髁突及关节间隙。两侧髁突的形态一般是对称的，经咽侧位（B对）可清晰的观察髁突的影像，避免髁突与颅骨影像重叠。下颌开口后前位（A错）片中髁突易与颌骨重叠，不用于检查髁突。升支侧位（C错）片常用于检查下颌升支外侧密质骨膨出、增生及破坏情况，一般不用于检查髁突。曲面体层（DE错）常用于检查上下颌骨肿瘤、外伤、炎症、畸形等病变及其与周围组织的关系，检查颞下颌时不如许勒位及经咽侧位清晰。